医学心理学的基本观点有
A. 3个
B. 4个
C. 5个
D. 6个
E. 7个

正确答案：D。6个

解析：我国医学心理学工作者根据多年的工作实践和科学研究，并引进最新自然科学的思想和概念，已经对人在健康和疾病的若干关系问题上建立了自己的理论体系。概括起来，大致有6个基本观点。掌握“医学心理学概述、任务与观点”知识点。